毛果芸香碱对眼睛的作用为
A. 缩瞳、调节麻痹、降低眼内压
B. 扩瞳、调节麻痹、升高眼内压
C. 缩瞳、调节痉挛、降低眼内压
D. 扩瞳、调节痉挛、降低眼内压
E. 缩瞳、调节痉挛、升高眼内压

正确答案：C。缩瞳、调节痉挛、降低眼内压